根据《处方管理办法》，医疗机构不得限制门诊就诊人员持处方到零售药店购药的是
A. 麻醉药品处方
B. 精神药品处方
C. 医疗用毒性药品处方
D. 妇科处方
E. 儿科处方

正确答案：D。妇科处方

解析：本题考查的是处方外流规定。根据《处方管理办法》，医疗机构不得限制门诊就诊人员持处方到零售药店购药的是妇科处方（D对）。处方外流规定：除麻醉药品（A错）、精神药品（B错）、医疗用毒性药品（C错）和儿科处方（E错）外，医疗机构不得限制门诊就诊人员持处方到药品零售企业购药